中心型肺癌最常见的早期症状是
A. 呼吸困难
B. 胸痛
C. 声音嘶哑
D. 发热
E. 刺激性咳嗽血痰

正确答案：E。刺激性咳嗽血痰

解析：中心型肺癌是指发生于段支气管至主支气管的肺癌，癌肿在较大的支气管内长大后，常出现刺激性咳嗽，当癌肿破裂出血时可出现血痰，通常为痰中带血点、血丝或断续地少量咯血（E对）。发热（D错）多是由于肿瘤引起的阻塞性肺炎所致，多为中晚期表现。胸痛（B错）常见于周围性肺癌，多由于肿瘤侵犯胸膜或肋间神经所致。声音嘶哑（C错）见于晚期肺癌患者，为癌肿压迫喉返神经所致。呼吸困难（A错）为癌肿堵塞较大的支气管所致，为中晚期症状。